方差分析借助F分布作统计推断的基本思想是根据变异来源分解
A. 方差
B. 均数
C. 离均差平方和
D. 抽样误差
E. 标准差

正确答案：C。离均差平方和